作用于二肽基肽酶4（DPP-4），为嘧啶二酮衍生物，适用于治疗2型糖尿病的药物是
A. 阿格列汀
B. 罗格列酮
C. 达格列净
D. 格列吡嗪
E. 那格列奈

正确答案：A。阿格列汀

解析：本题考查阿格列汀。作用于二肽基肽酶4（DPP-4），为嘧啶二酮衍生物，适用于治疗2型糖尿病的药物是阿格列汀（A对）。口服降糖药的分类：（1）磺酰脲类促胰岛素分泌药：代表药为格列本脲、格列吡嗪（D错）；（2）非磺酰脲类促胰岛分泌药：代表药为瑞格列奈、那格列奈（E错）；（3）双胍类药：二甲双胍；（4）α-葡萄糖苷酶抑制剂：代表药为阿卡波糖；（5）胰岛素增敏剂：代表药为罗格列酮（B错）、吡格列酮；（6）胰高糖素样肽-1受体激动剂：代表药为艾塞那肽、利拉鲁肽；（7）二肽基肽酶-4（DPP-4）抑制剂：代表药为西格列汀、阿格列汀。（8）钠-葡萄糖协同转运蛋白-2（SGLT-2）抑制药：达格列净（C错）和恩格列净等。